当归补血口服液的功能是
A. 补益元气
B. 补气养阴
C. 温补气血
D. 补养气血
E. 益气复脉

正确答案：D。补养气血

解析：本题考查的是补血口服液的功能。当归补血口服液的功能是补养气血（D对）。当归补血口服液：【功能】补养气血。消渴丸：【功能】滋肾养阴，益气生津。消渴丸，补气养阴（B错）生津，又与降糖西药合用，治气阴两伤消渴、糖尿病。十全大补丸：【功能】温补气血（C错）。生脉饮：【功能】益气复脉（E错），养阴生津。功能为补益元气（A错）的中成药，2022年考试指南未明确说明。